上述各项，符合“有利而不伤害”伦理原则的是
A. 有限的移植器官供体如何分配给需要者
B. 有些器官移植是在亲属间进行的
C. 用确认脑死亡患者的器官施行器官移植术
D. 器官移植者的人格完整有待改善
E. 器官移植的前景未达到全球的合作

正确答案：C。用确认脑死亡患者的器官施行器官移植术

解析：用确认脑死亡患者的器官施行器官移植术，既保护了器官接受者的利益，也未伤害器官提供者的健康，故符合“有利而不伤害”伦理原则（C对）。